与乌头相反的药有
A. 丹参
B. 瓜蒌仁
C. 白及
D. 浙贝母
E. 玄参

正确答案：B、C、D。瓜蒌仁；白及；浙贝母

解析：本题考查的是“十八反”配伍禁忌。与乌头相反的药有瓜蒌仁（B对）、白及（C对）与浙贝母（D对）。十八反列述了三组相反药，分别是：甘草反甘遂、京大戟、海藻、芫花；乌头（川乌、附子、草乌）反半夏、瓜蒌（全瓜蒌、瓜蒌皮、瓜蒌仁、天花粉）、贝母（川贝、浙贝）、白蔹、白及；藜芦反人参、南沙参、丹参（A错）、玄参（E错）、苦参、细辛、芍药（赤芍、白芍）。